根尖1/3折断，松Ⅰ度，正确处理为
A. 调（牙合）观察
B. 夹板固定、调（牙合）、定期复诊
C. 夹板固定后立即行根管治疗
D. 手术去除根尖断端
E. 根管内种植钛合金钉

正确答案：B。夹板固定、调（牙合）、定期复诊

解析：本题考查根折的治疗。根尖1/3折断，松Ⅰ度，应进行夹板固定，调牙合以防止咬合创伤，并定期复诊（B对）；若仅调（牙合）观察，折断的牙齿得不到固定会因活动而影响其自然愈合（A错）。根尖1/3折断，若立即进行根管治疗常可把根充糊剂压入断端之间，影响其修复（C错）。手术去除根尖断端常为根尖有器械折断的处置方式，一般不用于根尖1/3折断（D错）。根中1/3折断，且牙髓有炎症或坏死趋势，应作根管治疗，充填根管时不用牙胶尖，应在根管内种植钛合金或钴铬合金桩，将断端固定在一起，以利于根面牙骨质的沉积（E错）。